直接发自腹主动脉的血管是
A. 胃右动脉
B. 肝固有动脉
C. 肾上腺上动脉
D. 肾上腺中动脉
E. 肾上腺下动脉

正确答案：D。肾上腺中动脉

解析：肾上腺中动脉（D对）为直接发自腹主动脉的血管，为腹主动脉的成对的脏支。